正常成人每天唾液分泌量
A. 600-850ml
B. 900-1000ml
C. 1000-1500ml
D. 1600-1800ml
E. 2000-2500ml

正确答案：C。1000-1500ml

解析：本题考查唾液的分泌。正常成人每天唾液分泌量1000-1500ml（C对）。正常成人每天的唾液分泌量为1000～1500mL，其中的绝大多数来自三对大唾液腺。在无任何刺激的情况下，唾液的基础分泌为每分钟0.5mL。下颌下腺静止时分泌量最大，占60%～65%；腮腺占22%～30%，但对于进食等刺激的反应大于下颌下腺；舌下腺约占2%～4%；小唾液腺约占7%～8%。